男，35岁，1天前饮酒后出现上腹剧烈疼痛，伴恶心呕吐及腹胀，大小便正常。查体：上腹偏左腹肌紧张，明显压痛，腹部平片膈下未见游离气体。最可能的诊断是
A. 消化性溃疡穿孔
B. 肠梗阻
C. 急性阑尾炎
D. 胆石症
E. 急性胰腺炎

正确答案：E。急性胰腺炎

解析：青年男性患者，饮酒后（急性胰腺炎常见病因）出现上腹剧烈疼痛，伴恶心、呕吐及腹胀（急性胰腺炎的典型临床表现）。体查：上腹偏左腹肌紧张，明显压痛（腹膜刺激征）。腹部平片膈下未见游离气体（初步排除消化道穿孔）。综合该患者的病史、体查及影像学检查，最可能的诊断是急性胰腺炎（E对）。消化性溃疡穿孔（P340）（A错）多表现为上腹部刀割样剧痛，迅速波及全腹，腹膜刺激征明显，呈“板状腹”，但立位腹部平片常可见膈下新月状游离气体。肠梗阻（P358）（B错）多表现为腹痛、腹胀、呕吐、排气排便停止，X线可见气胀肠袢和气液平面。急性阑尾炎（P371）（C错）的典型临床表现为转移性右下腹痛伴腹膜刺激征，可有程度较轻的恶心、呕吐症状。胆石症（P439）（D错）多表现为进食油腻食物后右上腹阵发性绞痛，一般无腹膜刺激征。